四环素牙内脱色法所用的脱色剂是
A. 30％磷酸
B. 30％枸橼酸
C. 30％过氧化氢
D. 30％马来酸
E. 30％过氧化脲

正确答案：C。30％过氧化氢

解析：本题考查四环素牙内脱色法的脱色剂。四环素牙常用的漂白剂为30%过氧化氢（C对），还可用10%～15%过氧化脲（E错）。10%～37%磷酸常用作树脂充填时的酸蚀剂（A错）。30%枸橼酸在牙周翻手术中用于清洗暴露的牙根（B错）。